在众多的环境致癌因素中，物理性致癌因素约占
A. 0.05
B. 0.1
C. 0.15
D. 0.2

正确答案：A。0.05

解析：本题考查物理性致癌因素比例。在众多的环境致癌因素中，物理性致癌因素约占5%（A对BCD错）。